男，36岁。心悸3年，既往体健。查体：BP130/80mmHg，双肺未闻及湿啰音，心脏各瓣膜区未闻及杂音，心律不齐。心电图示：心室率140次/分，P波消失，代之大小不等的f波。该患者最可能出现的体征是
A. 发绀
B. 二尖瓣面容
C. 脉短拙
D. A₂亢进
E. 双下肢水肿

正确答案：C。脉短拙

解析：患者青年男性，有心悸病史，既往体健，查体未见明显异常，心电图显示P波消失，出现f波（房颤的典型波形），心律不齐（房颤的典型体征），心室率140次/分（正常值60～100次/分，心房颤动患者心室率常在100～160次/分），结合患者的病史和心电图检查，考虑诊断为心房颤动。心房颤动的听诊特点是心律绝对不规则、第一心音强弱不等和脉率少于心率（脉短绌）。脉短绌（C对）产生的原因是许多心室搏动过弱以致未能开启主动脉瓣，或因动脉血压波太小未能传至外周动脉。发绀（P139）（A错）是缺氧的典型表现，房颤时可能由于心脏排出量下降造成肺淤血从而导致呼吸困难，但极少达到发绀的程度。二尖瓣面容（九版诊断学P92）（B错）指面色晦暗、双颊紫红、口唇轻度发绀，常见于风湿性心瓣膜病二尖瓣狭窄。A₂（主动脉区第二心音）亢进（D错）常见于外周血管阻力升高和血流量增多时，如高血压、动脉粥样硬化（九版诊断学P157）。双下肢水肿（E错）常见于右心衰患者，主要由体循环淤血引起，房颤时排血量下降可能导致体静脉淤血，但一般较少严重到出现水肿症状。